不属于社会经济指标的是
A. Engel指数
B. 收入弹性
C. 人均收入及人均收人增长率
D. 食品深加工比值
E. 人均动物食品增长率或销售额

正确答案：D。食品深加工比值